若正在接受根管治疗而根尖周损害仍在继续加重，应考虑根尖周有哪种细菌感染的可能
A. 卟啉菌
B. 普氏菌
C. 放线菌
D. 真杆菌
E. 韦荣球菌

正确答案：C。放线菌

解析：本题考查牙髓根尖周病各感染部位中的主要细菌-感染根管。顽固性根尖周病和窦道经久不愈可能与放线菌感染有关，若正在接受根管治疗而根尖周损害仍在继续加重，应考虑根尖周有放线菌感染（C对）。卟啉菌（A错）、普氏菌（B错）、真杆菌（D错）、韦荣球菌（E错）是感染根管中的优势菌。